血脑屏障是指
A. 血-脑屏障
B. 血-脑脊液屏障
C. 脑脊液-脑细胞屏障
D. 上述三种屏障合称
E. 第一和第三种屏障合称

正确答案：D。上述三种屏障合称